根据《药品经营质量管理规范》及其有关附录文件，属于温湿度自动监测系统特有的验证项目是
A. 测点终端安装数量及位置确认
B. 测点终端参数与数据联动传输确认
C. 运输最长时限验证
D. 极端温度保温性能验证

正确答案：A。测点终端安装数量及位置确认

解析：本题考查的是药品经营质量管理规范附录文件《验证管理》。根据《药品经营质量管理规范》及其有关附录文件，属于温湿度自动监测系统特有的验证项目是测点终端安装数量及位置确认（A对）。温湿度自动监测系统验证项目包括：采集、传送、记录数据及报警功能确认，监测范围和精度确认，测点终端安装数量及位置确认，系统独立安全运行性能确认（不得与温湿度调控联动），系统在断电、计算机关机状态下的应急性能确认，防止用户修改、删除、反向导入数据等功能确认。冷藏箱（保温箱）验证项目包括：箱内温度分布特性，蓄冷剂配备使用（蓄冷剂与保温箱采取摆列组合式捆绑验证），测点终端位置，开箱作业对箱内温度影响，极端温度保温性能，运输最长时限验证（C错）。极端温度保温性能验证（D错）为冷库、冷藏车、保温箱共有的验证项目。